男，30岁。体检发现血脂增高。实验室检查：TC4.6mmol/L，TG5.6mmol/L，在询问患者高脂血症病因相关病史时应重点关注
A. 神经性厌食病史
B. 酗酒史
C. 肾病综合征病史
D. 原发性胆汁性肝硬化病史
E. 甲状腺功能亢进症病史

正确答案：B。酗酒史

解析：青年男性，血脂增高。TC4.6mmol/L（＜5.2，合适水平），TG5.6mmol/L（＞2.3，升高），在询问患者高脂血症病因相关病史时应重点关注酗酒史（B对）。肾病综合征（C错）TC升高，TG可能升高。甲状腺功能亢进症（E错）TG下降。